关于直肠给药栓剂的正确表述有
A. 对胃有刺激性的药物可直肠给药
B. 药物的吸收只有一条途径
C. 药物的吸收比口服干扰因素少
D. 既可以产生局部作用，也可以产生全身作用
E. 中空栓剂是以速率为目的的直肠吸收制剂

正确答案：A、C、D、E。对胃有刺激性的药物可直肠给药；药物的吸收比口服干扰因素少；既可以产生局部作用，也可以产生全身作用；中空栓剂是以速率为目的的直肠吸收制剂

解析：本题考查栓剂。药物用直肠栓避免了药物对胃黏膜的刺激性（A对）；比口服干扰因素少（C对）；栓剂有局部作用栓剂，也有全身作用栓剂（D对）；中空栓药物溶出速度比普通栓剂要快，可达到快速释药目的（E对）；药物的吸收有两条途径，可以经过局部作用吸收，也可经全身作用吸收（B错）。